寻找痰液中的结核分枝杆菌用什么染色
A. 瑞氏染色
B. 抗酸染色
C. 墨汁负染色
D. 棉兰染色
E. 革兰染色

正确答案：B。抗酸染色

解析：本题考查分枝杆菌。寻找痰液中的结核分枝杆菌用抗酸（B对）染色。结核分枝杆菌（简称结核菌）细长略弯曲，有时呈分枝状排列。因其细胞壁含有大量脂质，不易着色，经齐-尼抗酸染色呈红色，无菌毛和鞭毛，不形成芽孢，有荚膜。瑞氏染色（A错）适用于组织胞浆菌。抗酸染色（B错）用于结核分枝杆菌。墨汁负染色（C错）用于新型隐球菌荚膜。棉兰染色（D错）主要用于真菌。革兰染色（E错）用于链球菌属。